治疗经行吐衄肝经郁热证，应
A. 丹栀逍遥散
B. 顺经汤
C. 龙胆泻肝汤
D. 清肝引经汤
E. 芩连四物汤

正确答案：D。清肝引经汤

解析：清肝引经汤具有清热调经、凉血止血的功效，适于血热或肝郁化火的月经病（D对）。丹栀逍遥散（A错）具有疏肝解郁，清热调经的功效，适于心肝火旺证，无引血归经或止血之效。顺经汤（B错）具有补肾清肝的功效，主治妇人肾阴不足，肝气上逆证。龙胆泻肝汤（C错）适于肝胆湿热证。芩连四物汤（E错）功在养血清热，主治妇人血分有热，月经先期证。